患儿，10岁。昨天受凉后，见喷嚏、鼻塞、流清涕，今晨起喘咳，咳痰稠黄，口渴欲饮，大便干燥。查体：鼻煽，口周发绀，咽红，双肺满布哮鸣音，舌质红，苔薄白，脉滑数。其证候是
A. 寒性哮喘
B. 热性哮喘
C. 外寒内热
D. 肺实肾虚
E. 肺肾阴虚

正确答案：C。外寒内热

解析：题中患儿受凉后，见喷嚏、鼻塞、流清涕为外感风寒之邪，晨起喘咳，咳痰稠黄为风寒之邪引动伏痰所致，咳痰黄稠，口渴欲饮，大便干燥为里热之象，患儿双肺满布哮鸣音故诊断为哮喘，辨证为外寒内热证。寒性哮喘有风寒在表的表现，见恶寒无汗、鼻流清涕、脉浮紧，内有痰湿之邪，阳气不能宣畅，见面色淡白、痰多白沫、舌淡苔白等（A错）。热性哮喘为外感风热之邪，引动伏痰，痰热相结，阻于气道所致，以咳嗽喘急，声高息涌，咳痰黄稠，身热咽红，舌红苔黄为表现（B错）。题中患儿辨为外寒内热证（C对）。肺实肾虚证为上盛下虚之象，上盛肺实，见喘促胸满，咳嗽痰鸣，下虚肾亏，见喘息无力，动则尤甚，畏寒肢冷，神疲（D错）。肺肾阴虚证以咳嗽时作，喘促无力，动则气短，干咳少痰，消瘦气短，夜间盗汗，手足心热等症状，无外感表证之象（E错）。